了解详细药物相互作用，可检索文献
A. 《中国药典临床用药须知》
B. 《中国国家处方集》
C. 《治疗学药理学基础》
D. 《药理学与药物治疗学》
E. 《马丁代尔药物大典》

正确答案：B、E。《中国国家处方集》；《马丁代尔药物大典》

解析：本题考查常用中外文药学专著及期刊。了解详细药物相互作用，可检索文献《中国国家处方集》（B对）、《马丁代尔药物大典》（E对）。《中国药典临床用药须知》（A错）对指导合理用药具有较大的参考价值。《治疗学药理学基础》（C错）书中有许多药动学和药效学信息。《药理学与药物治疗学》（D错）包括药理学基础理论、药物治疗学。